常先出现鼻阻塞、鼻出血
A. 肿瘤发生自上颌窦下壁
B. 肿瘤发生自上颌窦内壁
C. 肿瘤发生自上颌窦后壁
D. 肿瘤发生自上颌窦上壁
E. 肿瘤发生自上颌窦外壁上颌窦癌根据肿瘤发生的部位，临床上可出现不同的症状

正确答案：B。肿瘤发生自上颌窦内壁

解析：上颌窦癌根据肿瘤发生的部位，临床上可出现不同的症状：肿瘤发生自上颌窦内壁时，常先出现鼻阻塞、鼻出血，一侧鼻腔分泌物增多，鼻泪管阻塞有流泪现象。掌握“中央性颌骨癌及上颌窦癌”知识点。